传染源通过产生（≤5μm）微生物的飞沫传播的是
A. 直接接触传播
B. 间接接触传播
C. 飞沫传播
D. 空气传播
E. 性传播

正确答案：D。空气传播

解析：空气传播：病原微生物经由悬浮在空气中的微粒如飞沫核（≤5μm）、菌尘来传播的方式。这种微粒能在空气中悬浮较长时间，并可随气流漂浮到较远处。掌握“口腔医疗保健中的感染”知识点。